长期大量服用可引起视力模糊、乳腺肿大，并有出现血栓性静脉炎或栓塞危险的维生素是
A. 维生素A
B. 维生素B₆
C. 维生素C
D. 维生素D
E. 维生素E

正确答案：E。维生素E

解析：本题考查维生素E的不良反应。维生素E（E对）大量服用时可引起视物模糊、乳腺肿大、类流感样综合征、胃痉挛、疲乏、软弱；长期超量服用可引起出血倾向，并会出现血栓危险。维生素A（A错）长期大量服用可引起慢性中毒。维生素B₆（B错）长期大量服用可引起严重神经感觉异常。维生素C（C错）大量服用可能引起尿酸盐、半胱氨酸或草酸盐结石。维生素D（D错）长期大量服用可会引起低热、惊厥、厌食、肝肾损害，骨硬化等症。